中枢性瘫痪的特点是
A. 肌张力降低
B. 腱反射减弱
C. 浅反射消失
D. 不出现病理反射
E. 肌张力增强

正确答案：E。肌张力增强

解析：中枢性瘫痪临床主要表现为：肌张力增强（E对A错），腱反射亢进（B错），出现病理反射（D错），浅反射减弱或消失（C错）但无肌肉萎缩，呈痉挛性瘫痪。